最容易发生酸水解反应的苷类化合物是
A. 硫苷
B. 氮苷
C. 醇苷
D. 碳苷
E. 酚苷

正确答案：B。氮苷

解析：本题考查苷的化学性质。最容易发生酸水解反应的苷类化合物是氮苷（B对）。按苷键原子不同，酸水解的易难顺序为：N-苷>O-苷>S-苷（A错）>C-苷（D错）。C上无未共享电子对，不能质子化，很难水解。而N碱度大，易接受质子，故最易水解。但当N原子处于嘧啶或酰胺位置时，也难于用无机酸水解。氧苷（O-苷）以苷元不同又可分为醇苷（C错）、酚苷（E错）、氰苷、酯苷和吲哚苷。